男，50岁。口腔内起白斑。检查：口腔内左侧黏膜及腭上灰白色光滑而微隆起的斑块，双侧前臂散在性玫瑰红色斑疹。低烧，头痛。患者自述阴茎部曾有过溃疡，已痊愈。该病初步印象是梅毒，首选的治疗药物是
A. 制霉菌素
B. 卡那霉素
C. 链霉素
D. 青霉素
E. 红霉素

正确答案：D。青霉素

解析：本题考查梅毒的治疗药物。经过50多年的临床应用和实验研究及专家认定，确定梅毒的治疗药物首选青霉素（D对）。制霉菌素（A错）多用于治疗白念珠菌的感染。卡那霉素（B错）的敏感菌主要为大肠杆菌、克雷伯杆菌、肠杆菌术、变形杆菌、结核杆菌和金黄色葡萄球菌。链霉素（C错）主要用于各种皮肤结核病的治疗。红霉素（E错）可作为军团菌肺炎和支原体肺炎的首选药。